不是孕妇禁用的中药是
A. 桃仁
B. 红花
C. 乳香
D. 没药
E. 天仙藤

正确答案：E。天仙藤

解析：根据第七版教材天仙藤虽有行气活血之功，但功效缓和，可治疗妊娠水肿，产后血气腹痛等，为孕妇可用之药第九版教材（P325）天仙藤孕妇禁服。由于此题出题的年份是按照第七版教材考的，故此题选E（E错，为本题正确答案）。桃仁（A对）、红花（B对）、乳香（C对）、没药（D对）活血化瘀之力强峻，易损伤胞胎引起滑胎。